位于脊髓的交叉
A. 锥体交叉
B. 内侧丘系交叉
C. 三叉丘系交叉
D. 听觉二级纤维交叉
E. 脊髓丘脑束纤维交叉

正确答案：E。脊髓丘脑束纤维交叉

解析：位于脊髓的交叉是脊髓丘脑束纤维交叉（E对）。锥体交叉（A错）、内侧丘系交叉（B错）、三叉丘系交叉（C错）、听觉二级纤维交叉（D错）均位于脑干。